我国规定婴幼儿奶粉中黄曲霉毒素M₁的限量标准为
A. ≤1.0μg/kg
B. ≤0.5μg/kg
C. ≤0.2μg/kg
D. ≤0.1μg/kg
E. 不得检出

正确答案：E。不得检出

解析：本题考查我国规定婴幼儿奶粉中黄曲霉毒素M₁的限量标准。我国规定大米、食用油中黄曲霉毒素M₁允许量标准为10ug/kg，其他粮食、豆类及发酵食品为5ug/kg，婴儿代乳食品不得检出（E对ABCD错）。